某女，5岁。体胖，嗜食肥甘，近日感冒发热、咳嗽痰多，证属外感风寒、痰浊阻肺，宜选用的成药是
A. 小儿咳喘灵颗粒
B. 健脾康儿片
C. 解肌宁嗽丸
D. 肥儿丸
E. 鹭鸶咯丸

正确答案：C。解肌宁嗽丸

解析：本题考查的是解肌宁嗽丸的主治。某女，5岁。体胖，嗜食肥甘，近日感冒发热、咳嗽痰多，证属外感风寒、痰浊阻肺，宜选用的成药是解肌宁嗽丸（C对）。解肌宁嗽丸：【主治】外感风寒、痰浊阻肺所致的小儿感冒发热、咳嗽痰多。小儿咳喘灵颗粒（A错）：【主治】小儿外感风热所致的感冒、咳喘，症见发热、恶风、微有汗出、咳嗽咯痰、咳喘气促；上呼吸道感染、支气管炎、肺炎见上述证候者。健脾康儿片（B错）：【主治】脾胃气虚所致的泄泻，症见腹胀便泻、面黄肌瘦、食少倦怠、小便短少。肥儿丸（D错）：【主治】小儿消化不良，虫积腹痛，面黄肌瘦，食少腹胀泄泻。鹭鸶咯丸（E错）：【主治】痰浊阻肺所致的顿咳、咳嗽，症见咳嗽阵作、痰鸣气促、咽干声哑；百日咳见上述证候者。